肾上腺素与异丙肾上腺素共同的适应证是
A. 过敏性休克
B. 房室传导阻滞
C. 与局麻药配伍，延长局麻药的作用时间
D. 支气管哮喘
E. 局部止血

正确答案：D。支气管哮喘